物像落在视网膜前，形成模糊的物像，通常被称为
A. 青光眼
B. 近视眼
C. 白内障
D. 远视
E. 老视

正确答案：B。近视眼

解析：青光眼（A错）是指房水代谢紊乱或循环不畅而造成的眼内压增高。物像落在视网膜前，形成模糊的物像，通常被称为近视眼（B对）。远视（D错）是指物像落在视网膜后，形成模糊的物像。白内障（C错）是指晶状体若因疾病或创伤而变混浊。老视（E错）是指随年龄增长，晶状体核逐渐增大变硬、弹性减退，睫状肌逐渐萎缩，晶状体的调节能力逐渐减弱，近距离视物困难。